高血钾的水肿患者，禁用下列哪种利尿药
A. 呋喃苯胺酸
B. 利尿酸
C. 安体舒通
D. 山梨醇
E. 氢氯噻嗪

正确答案：C。安体舒通

解析：本题考查利尿药的禁忌症。高血钾的水肿患者，禁用安体舒通（C对）。螺内酯禁用于高钾血症者。呋喃苯胺酸（A错）即呋塞米禁用于交叉过敏、孕妇、低钾血症、超量服用洋地黄以及肝性脑病患者。利尿酸（B错）即依他尼酸禁用于无尿者、婴儿、孕妇和服用本品后发生严重样腹泻者。山梨醇（D错）禁用于急性肾小管坏死的无尿者、严重失水者以及急性肺水肿。氢氯噻嗪（E错）禁用于对其他类磺胺衍生物过敏者、肝性脑病、严重的肾功能损害、顽固性低钾血症、高钙血症者。